通过竞争性抑制α-葡萄糖苷酶的活性，减慢淀粉等多糖分解为双糖和单糖，延缓单糖的吸收，降低餐后血糖峰值的药物是
A. 吡格列酮
B. 伏格列波糖
C. 瑞格列奈
D. 门冬胰岛素
E. 格列吡嗪

正确答案：B。伏格列波糖

解析：本题考查伏格列波糖。通过竞争性抑制α-葡萄糖苷酶的活性，减慢淀粉等多糖分解为双糖和单糖，延缓单糖的吸收，降低餐后血糖峰值的药物是伏格列波糖（B对）。吡格列酮（A错）属噻唑烷二酮类口服抗糖尿病药，为高选择性过氧化物酶增殖体激活受体γ(PPARγ）的激动剂，通过提高外周和肝脏的胰岛素敏感性而控制血糖水平。瑞格列奈（C错）能够诱导β细胞分泌胰岛素，通过促进胰腺释放胰岛素来降低血糖水平。门冬胰岛素（D错）的降血糖作用是通过其分子与肌肉和脂肪细胞上的胰岛素受体结合后，促进细胞对葡萄糖吸收利用，同时抑制肝脏葡萄糖的输出实现的。格列吡嗪（E错）与β细胞膜上的磺酰脲受体特异性结合，从而使K⁺通道关闭，引起膜电位改变，Ca²⁺通道开启，胞液内Ca²⁺升高，促使胰岛素分泌。